病人甲输液中发生反应，经对症处置，症状消失，当天夜里出现心悸、呼吸困难，晨5时死亡。家属认为是医院的责任，拒不从病房移走尸体。第2天上午上班，院方决定做尸检请法医魏某做。下午魏某告知院方因紧急会务不能去做，家属也不同意尸检，第3天又请到法医李某，经与家属协商，第4天进行了尸检，李某未能对死因作出解释。使纠纷无法结论，对这一结果
A. 只能以死因不明定论
B. 魏某承担因拖延而迟延尸检，无法结论的结果
C. 李某承担因未做出解释而无法结论的结果
D. 院方承担因请人不当而无法结论的结果
E. 家属承担因不同意尸检迟延尸检而无法结论的结果

正确答案：E。家属承担因不同意尸检迟延尸检而无法结论的结果

解析：《医疗事故处理条例》中患者死亡，医患双方当事人不能确定死因或者对死因有异议的，应当在患者死亡后48小时内进行尸检；具备尸体冻存条件的，可以延长至7日。尸检应当经死者近亲属同意并签字。尸检应当由按照国家有关规定取得相应资格的机构和病理解剖专业技术人员进行。承担尸检任务的机构和病理解剖专业技术人员有进行尸检的义务。医疗事故争议双方当事人可以请法医病理学人员参加尸检，也可以委派代表观察尸检过程。拒绝或者拖延尸检，超过规定时间，影响对死因判定的，由拒绝或者拖延的一方承担责任。掌握“医疗事故处理概述、预防与处置”知识点。